下列关于慢性肾衰竭及尿毒症的防治原则正确的是
A. 控制感染
B. 肾移植
C. 血液净化疗法
D. 饮食疗法
E. 以上都相关

正确答案：E。以上都相关

解析：慢性肾衰竭及尿毒症的防治原则包括：1.治疗原发病；2.消除加重肾损伤的因素，控制感染（A对）等；3.饮食控制与营养疗法（D对）；4.透析疗法（C对）；5.肾移植（B对）。